男性，47岁，发热伴胸部持续性疼痛3天，胸骨左缘第三、四肋间收缩期和舒张期均可听到粗糙呈搔抓样声音。此声音最可能是
A. 机器样杂音
B. 心包胸膜摩擦音
C. 胸膜摩擦音
D. 心包摩擦音
E. 二尖瓣狭窄合并关闭不全杂音

正确答案：D。心包摩擦音